下列属于冒险行为特征的是
A. 不是人类群体或个体所必需的
B. 主题清楚地知道这些行为对自身造成损失的机会比较大
C. 这些行为是否导致损失主要是由机会决定的
D. 以上答案都正确
E. 冒险过程本身和冒险的结果能够在一定程度上满足冒险者的某种心理需求

正确答案：D。以上答案都正确

解析：本题考查冒险行为的特征。冒险行为不是人类群体或个体所必需的；冒险主体清楚地知道这些行为对自身造成损失的机会比较大；冒险行为是否导致损失主要是由机会决定的；冒险过程本身和冒险的结果能够在一定程度上满足冒险者的某种心理需求。本题中以上描述均是正确的（D对ABCE错）。